痉挛性截瘫的典型步态是
A. 划圏样步态
B. 跨阈步态
C. 慌张步态
D. 剪刀样步态
E. 醉汉步态

正确答案：D。剪刀样步态

解析：剪刀样步态（D对）时，由于双下肢肌张力增高，尤以伸肌和内收肌张力增高明显，移步时下肢内收过度，双腿交叉呈剪刀状，见于脑性瘫痪与截瘫患者。划圏样步态（痉挛性偏瘫步态）（A错）下肢伸直、外旋，向外前摆动，行走时呈划圈样步态，见于脑卒中后遗症。跨阈步态（B错）时，由于踝部肌腱、肌肉弛缓，患足下垂，行走时必须抬高下肢才能起步，见于腓总神经麻痹。慌张步态（C错）时，起步后小步急速趋行，双脚擦地，身体前倾，有难以止步之势，见于帕金森病患者。醉酒步态（E错）时，行走时躯干重心不稳，步态紊乱不准确如醉酒状，见于小脑疾病、酒精及巴比妥中毒。